50岁女性，右肩痛，右上肢上举、外展受限8个月，无肩周红、肿、热等表现，疼痛可向颈、耳、前臂及手放射，最可能的诊断是
A. 肩关节骨关节炎
B. 肩周炎
C. 肩关节结核
D. 颈椎病
E. 类风湿性关节炎

正确答案：B。肩周炎

解析：本例患者为中年女性，有右肩痛，右上肢上举、外展受限的病史，疼痛向向颈、耳、前臂及手放射，肩周无红、肿、热等表现，排除感染的可能，最可能的诊断是肩周炎（B对）。肩关节骨关节炎（A错）患者临床表现为疼痛且活动多时疼痛加重，一般上肢上举、外展等活动不受限。肩关节结核（C错）患者多有结核病病史，常出现低热、盗汗、乏力等典型结核病症状。颈椎病（D错）患者临床表现为颈项肩背部的慢性疼痛，严重者可有神经受压症状，一般上肢上举、外展不受限。类风湿性关节炎（E错）受累关节多见于近端指间关节、掌指关节、腕关节、肘关节等，临床表现为关节活动受限、持续性肿胀和压痛。